以下哪项不属于神经调节的特点
A. 调节范围精准
B. 反应迅速
C. 灵敏
D. 短暂
E. 作用持久

正确答案：E。作用持久